职业中毒诊断前提和基本条件
A. 病史和临床检查
B. 生成环境调查
C. 接触有害物质的时间
D. 职业史及劳动卫生条件
E. 病理证实

正确答案：D。职业史及劳动卫生条件

解析：职业中毒的诊断即职业病的诊断原则包括：1.职业史，职业史是职业病诊断的重要前提（D对）。应详细询问患者现职工种、工龄、接触有害因素的种类、程度和时间（C错）、生产劳动方式、防护措施：既往工作经历，包括部队服役史、再就业史、打工史及兼职史等，以便判断患者接触毒物的机会和程度：2.职业卫生现场调查与危害评价（B错）3.临床表现及实验室检查（AE错）。